以恶心、呕吐为主要症状的食物中毒是
A. 沙门菌中毒
B. 副溶血性弧菌中毒
C. 葡萄球菌中毒
D. 肉毒杆菌中毒
E. 变形杆菌

正确答案：C。葡萄球菌中毒